停经3个月后不规则阴道流血2个月，经血量时多时少，常见为
A. 萎缩型子宫内膜
B. 子宫内膜腺囊型增生过长
C. 黄体功能不全
D. 黄体萎缩不全
E. 子宫内膜非典型性增生

正确答案：B。子宫内膜腺囊型增生过长

解析：患者停经3个月后不规则阴道流血2个月（月经周期紊乱），经血量时多时少（经量不定），可初步诊断为无排卵性功能失调性子宫出血。无排卵性功血患者的子宫内膜受雌激素持续作用而无孕激素拮抗，可发生不同程度的增生改变，其中，子宫内膜腺囊型增生过长（现称子宫内膜单纯型增生）（P345）（B对）为最常见的子宫内膜增生类型。仅少数无排卵性功血患者子宫内膜可呈萎缩性（A错）改变。黄体功能不全（P350）（C错）常见于生育年龄妇女，常表现为月经周期缩短，不孕或早孕时流产。黄体萎缩不全（P351）（D错）也常见于育龄妇女，表现为月经周期正常，但经期延长、经量增多等。无排卵性功血患者的子宫内膜非典型性增生（P345）（E错）不如子宫内膜腺囊型增生过长多见。